与触觉传导路无关的结构是
A. 脊髓丘脑前束
B. 脊髓后索
C. 脊髓后根
D. 内侧丘系
E. 内囊膝

正确答案：E。内囊膝

解析：处决的传导与躯干和四肢意识性本体感觉的精细触觉传导通路有关。该通路由3级神经元组成：第1级神经元为脊神经节内假单极神经元，中枢突经脊神经后根的内侧部（B对），进入脊髓后索（C对）。第2级神经元的胞体在薄、楔束核内，由此2核发出的纤维向前绕过中央灰质的腹侧，在中线上与对侧的交叉，称内侧丘系交叉，交叉后的纤维转折向上，形成内侧丘系（D对），最后止于背侧丘脑腹后外侧核。第3级神经元的胞体在背侧丘脑腹后外侧核（E错，为本题正确答案）。